关于注射剂有关规定的说法，正确的有
A. 混悬型注射剂不得用于静脉注射
B. 中药注射剂应以半成品投料配制成品
C. 乳状液型注射剂不得用于静脉滴注
D. 标示量不大于50ml的注射剂，灌装时，应适当增加装量
E. 多剂量包装注射剂，每一容器包装不得超过10次注射量

正确答案：A、B、D、E。混悬型注射剂不得用于静脉注射；中药注射剂应以半成品投料配制成品；标示量不大于50ml的注射剂，灌装时，应适当增加装量；多剂量包装注射剂，每一容器包装不得超过10次注射量

解析：本题考查的是注射剂生产与贮藏的有关规定。关于注射剂有关规定的说法，正确的有关于注射剂有关规定的说法，正确的有混悬型注射剂不得用于静脉注射（A对）、中药注射剂应以半成品投料配制成品（B对）、标示量不大于50ml的注射剂，灌装时，应适当增加装量（D对）与多剂量包装注射剂，每一容器包装不得超过10次注射量（E对）。注射剂生产与贮存过程：（1）溶液型注射剂应澄清。除另有规定外，混悬型注射液中原料药物粒径应控制在15μm以下，含15～20μm（间有个别20～50μm）者，不应超过10%，若有可见沉淀，振摇时应容易分散均匀。混悬型注射液不得用于静脉注射或椎管内注射；乳状液型注射液不得有相分离现象，不得用于椎管内注射。静脉用乳状液型（C错）注射液中90%的乳滴粒径应在1μm以下，不得有大于5μm的乳滴。除另有规定外，输液应尽可能与血液等渗。（2）注射剂所用的原辅料应从来源及工艺等环节进行严格控制并应符合注射用的质量要求。注射剂所用溶剂必须安全无害，并不得影响疗效和药品质量，一般分为水性溶剂和非水性溶剂。（3）配制注射剂时，可根据药物的性质加入适宜的附加剂。（4）注射剂常用容器有玻璃安瓿、玻璃瓶、塑料安瓿、塑料瓶（袋）、预装式注射器等。除另有规定外，容器应足够透明，以便内容物的检视。（5）在注射剂的生产过程中应尽可能缩短配制时间，防止微生物与热原的污染及原料药物变质。（6）灌装标示量为不大于50ml的注射剂时，应适当增加装量。除另有规定外，多剂量包装的注射剂，每一容器的装量一般不得超过10次注射量，增加的装量应能保证每次注射用量。（7）注射剂熔封或严封后，一般应根据原料药物性质选用适宜的方法灭菌，必须保证制成品无菌。（8）除另有规定外，注射剂应避光贮存。（9）注射剂的标签或说明书中应标明其中所用辅料的名称，如有抑菌剂还应标明抑菌剂的种类及浓度；注射用无菌粉末应标明配制溶液所用的溶剂的种类，必要时还应标注溶剂量。（10）除另有规定外，制备中药注射剂的饮片等原料应按各品种项下规定的方法提取、纯化、制成半成品、成品，并进行相应的质量控制。